下列不属于急性化脓性腮腺炎切开引流的指征
A. 全身中毒症状明显
B. 明显的凹陷性水肿
C. 皮肤表面红肿热痛
D. 腮腺导管口有脓溢出
E. 局部跳痛、局限性压痛

正确答案：C。皮肤表面红肿热痛

解析：本题考查急性化脓性腮腺炎。皮肤表面红肿热痛（C错，为本题正确答案）不属于急性化脓性腮腺炎切开引流的指征。切开引流指征：①局部有明显的凹陷性水肿（B对）；②局部有跳痛并有局限性压痛点（E对），穿刺抽出脓液；③腮腺导管口有脓液排出（D对），全身感染中毒症状明显（A对）。